胆道疾病引起的腹痛多放射至
A. 左肩部
B. 右肩部
C. 背部
D. 左腰背
E. 右股内侧

正确答案：B。右肩部

解析：胆道疾病引起的腹痛多放射至右肩部（B对），胆囊的传入神经为内脏大神经，相应的脊髓节段为胸髓节7-8，相应的体表感应部位为右上腹及右肩胛。疼痛放射至左肩部（A错）可见于心绞痛、心肌梗死等。背部（C错）放射痛可见于胃、十二指肠疾病、骨科疾病等。左腰背（D错）放射痛可见于左肾结石等。右股内侧（E错）放射痛可见于腰椎间盘突出症等。